女性患者，甲状腺肿大伴多汗、多食、消瘦、心悸、烦躁，根据同位素扫面及血T₃、T₄检查，诊断为甲亢。该病人内科治疗宜选用
A. 甲状腺素
B. 甲巯咪唑
C. 碘剂
D. 放射性碘
E. 肾上腺皮质激素

正确答案：B。甲巯咪唑

解析：本题考查抗甲状腺药物。女性患者，甲状腺肿大伴多汗、多食、消瘦、心悸、烦躁，根据同位素扫面及血T₃、T₄检查，诊断为甲亢。该病人内科治疗宜选用甲巯咪唑（B对）。甲状腺素（A错）可用于甲状腺功能减退症。碘剂（C错）主要用于甲状腺功能亢进的术前准备。放射性碘（D错）主要用于主要适用于对ATD过敏，拒绝手术治疗或者有手术禁忌症者。肾上腺皮质激素（E错）可用于甲状腺危象。